上颌神经的翼腭窝段发出的分支不包括
A. 颧神经
B. 翼腭神经
C. 上牙槽后神经
D. 上牙槽前神经
E. 腭神经

正确答案：D。上牙槽前神经

解析：本题考查上颌神经。上颌神经的翼腭窝段发出的分支不包括上牙槽前神经（D错，为本题的正确答案）。上牙槽前神经和上牙槽中神经属于眶内段。上颌神经为感觉神经，可分为四段：颅中窝段、翼腭窝段、眶内段、面段。翼腭窝段发出颧神经（A对）、翼腭神经（BE对）及上牙槽后神经（C对）。